某药半衰期为5小时，1次用药后从体内基本消除（消除95%以上）的最短时间是
A. 10小时左右
B. 1天左右
C. 2天左右
D. 5天左右
E. 10天左右

正确答案：B。1天左右

解析：半衰期t1/2一般是指血药浓度下降一半所需要的时间，也称血浆半衰期，它反映了药物消除的快慢的程度，t1/2与药物转运和转化关系为：一次用药后经过42004U2-6个t1/2后体内药量消除93.5%2004U2-98.4%，一次半衰期为5小时的药物，一次用药后消除95%以上需要202004U2-30小时（B对）。